下列有关苯妥英钠的叙述中错误的是
A. 治疗某些心律失常有效
B. 能引起牙龈增生
C. 能治疗三叉神经痛
D. 治疗癫痫大发作有效
E. 口服吸收规则，t1/2个体差异小

正确答案：E。口服吸收规则，t1/2个体差异小

解析：本题考查苯妥英钠。苯妥英钠为乙内酰脲类药，口服吸收较缓慢，绝大部分在小肠内吸收（E错为本题正确答案）；苯妥英钠可用于室性或室上性心律失常（A对）、三叉神经痛（C对），同时是癫痫大发作（D对）和局限性发作首选药；牙龈增生（B对）为其不良反应。